一患者下颌左5678右678缺失，左下4不松动、无龋，牙槽嵴丰满。铸造支架式义齿左下4右下5远中牙合支托、三臂卡固位体，舌杆大连接体。义齿戴用1周后，主诉基托压痛、基牙咬合痛。口腔内检查发现：舌系带根部小溃疡，左侧下颌隆凸处黏膜红肿，左下4叩痛（+），义齿各部分密合，咬合不高。左侧下颌隆凸压痛的处理方法是
A. 义齿基托边缘磨除
B. 义齿基托组织面相应处缓冲
C. 义齿基托组织面重衬
D. 调（牙合）
E. 调整左下4卡环的固位力

正确答案：B。义齿基托组织面相应处缓冲

解析：本题考查左侧下颌隆凸压痛的处理方法。可摘局部义齿戴用后出现左侧下颌隆凸压痛现象，说明下颌隆突处缓冲不够，应在义齿基托组织面相应处缓冲（B对）。义齿基托边缘磨除（A错）适用于基托边缘过长造成软组织疼痛的情况。义齿基托组织面重衬（C错）适用于基托组织面与黏膜不密合时，调（牙合）（D错）适用于（牙合）不平衡，有早接触现象等。调整左下4卡环的固位力（E错），适用于义齿固位力不足，容易脱位的情况。